治疗鼠疫宜选用的药物是
A. 庆大霉素
B. 青霉素
C. 链霉素
D. 阿米卡星
E. 奈替米星

正确答案：C。链霉素

解析：本题考查链霉素。链霉素（C对）与四环素联合用药已成为目前治疗鼠疫最为有效手段。庆大霉素（A错）是治疗各种G⁻杆菌感染的主要抗菌药。青霉素（B错）为治疗敏感的G⁺球菌和杆菌、G⁻球菌及螺旋体所致感染的首选药。阿卡米星（D错）是一些氨基糖苷类耐药菌感染的首选药。两性霉素B（E错）为广谱抗菌药，是治疗各种严重真菌感染的首选药之一。